使用0.12%或0.2%氯己定液含漱，每天2次，每次10ml，每次1分钟，可抑制一定的菌斑形成，牙龈炎可减少
A. 27%～45%
B. 27%～67%
C. 45%～61%
D. 45%～87%
E. 61%～87%

正确答案：B。27%～67%

解析：使用0.12%或0.2%氯己定液含漱，每天2次，每次10ml，每次1分钟，可抑制菌斑形成达45%～61%，牙龈炎可减少27%～67%。掌握“菌斑控制及提高宿主抵抗力”知识点。